用于过敏、镇静，但青光眼、癫痫、甲亢患者应慎用的是
A. 盐酸异丙嗪
B. 马来酸氯苯那敏
C. 盐酸苯海拉明
D. 茶苯海明
E. 盐酸地芬尼多

正确答案：A。盐酸异丙嗪